以DNA损伤为检测终点的致突变试验是
A. 微核试验
B. 染色体畸变试验
C. UDS试验
D. Ames试验

正确答案：C。UDS试验

解析：本题考查以DNA损伤为检测终点的致突变试验。以DNA损伤为检测终点的致突变试验是程序外DNA合成实验（UDS）（C对ABD错）。